锐利边缘易造成的损伤
A. 牙龈炎
B. 食物嵌塞
C. 全身健康
D. 垂直距离变短
E. 口腔黏膜软组织

正确答案：E。口腔黏膜软组织

解析：牙体缺损可直接影响患者的功能、美观、发音和心理状态等。锐利边缘容易刮伤口腔黏膜和舌等软组织。掌握“牙体缺损病因及影响”知识点。